腹股沟韧带
A. 位于髂前下棘与耻骨结节之间
B. 由腹外斜肌腱膜构成
C. 由腹内斜肌腱膜构成
D. 构成腹股沟管的前壁
E. 构成腹股沟管的后壁

正确答案：B。由腹外斜肌腱膜构成

解析：腹股沟韧带位于髂前上棘与耻骨结节之间，而非髂前下棘与耻骨结节之间（A错），由腹外斜肌腱膜构成（B对），而非腹内斜肌腱膜（C错），构成腹股沟管的下壁，而非前壁（D错），也非后壁（E错）。